某男，50岁，素体气虚乏力，今日又患热毒疮痈。治当选用性寒，既健脾益气又清热解毒之品。符合这一条件的药是
A. 绞股蓝
B. 刺五加
C. 白扁豆
D. 红景天
E. 西洋参

正确答案：A。绞股蓝

解析：本题考查的是绞股蓝的功效。素体气虚乏力，今日又患热毒疮痈。治当选用性寒，既健脾益气又清热解毒之品。符合这一条件的药是绞股蓝（A对）。绞股蓝：【功效】健脾益气，祛痰止咳，清热解毒。刺五加（B错）：【功效】补气健脾，益肾强腰，养心安神，活血通络。白扁豆（C错）：【功效】健脾化湿，消暑解毒。红景天（D错）：【功效】益气，平喘，活血通脉。西洋参（E错）：【功效】补气养阴，清热生津。